未婚女性，28岁。闭经2年。肛诊：子宫正常大小。孕激素试验阴性。下一步最佳检查方法是
A. 垂体兴奋试验
B. 基础体温测定
C. 染色体检查
D. 孕激素水平测定
E. 雌激素试验

正确答案：E。雌激素试验

解析：患者为年轻女性，闭经2年，肛诊：子宫正常大小，孕激素试验阴性时，应进一步行雌孕激素试验（E对）。停药后出现撤药性出血者为阳性，提示子宫内膜功能正常，可排除子宫性闭经，引起闭经的原因是体内雌激素水平低落；无撤药性出血者为阴性，提示子宫内膜有缺陷或被破坏，可诊断为子宫性闭经。垂体兴奋试验（P355）（A错）用于了解垂体对GnRH的反应性；周期性连续的基础体温测定（P370）（B错）可以大致反映排卵和黄体功能；染色体检查（P357）（C错）对鉴别性腺发育不全病因及指导临床处理有重要意义；孕激素水平测定（P356）（D错）可提示是否排卵。以上四项检查均对孕激素试验阴性的闭经患者诊断意义不大。